在儿科五脏疾病中，最常见的是
A. 肝系疾病
B. 心系疾病
C. 脾系疾病
D. 肺系疾病
E. 肾系疾病

正确答案：D。肺系疾病

解析：肺为华盖，处于较高位置，且小儿之肺尤为轻灵娇嫩，卫表未固，凡六淫外邪，均先犯于肺，故小儿最常见肺系疾病（D对）。小儿肝常有余，心常有余，易见肝风、心惊的症候，而肾常虚，常见肾精失充，骨骼改变的疾病，但其发病率不足肺系疾病（ABE错）。小儿脾常不足，其发病率位居于第二（C错）。